关于传染的概念，下列哪项是错误的
A. 传染也称感染
B. 感染病原体后是否发病，主要取决于病原体的特性
C. 感染病原体后是否发病，主要取决于人体的抗病能力
D. 传染病是传染或感染过程中的表现形式之一，感染病原体后不一定都发病
E. 构成传染过程必需具备病原体，人体及环境三个因素

正确答案：B。感染病原体后是否发病，主要取决于病原体的特性